根据《国家基本药物目录管理办法（暂行）》，国家基本药物遴选原则是
A. 安全、有效、经济
B. 安全、有效、质量可控
C. 临床必需、安全有效、价格合理、使用方便、市场能够保证供应
D. 保证品种和质量、引入竞争机制、合理控制成本、方便购药和便于管理
E. 防治必需、安全有效、价格合理、使用方便、中西药并重、基本保障、临床首选和基层能够配备

正确答案：E。防治必需、安全有效、价格合理、使用方便、中西药并重、基本保障、临床首选和基层能够配备

解析：本题考查的是国家基本药物目录的制定。根据《国家基本药物目录管理办法（暂行）》，国家基本药物遴选原则是防治必需、安全有效、价格合理、使用方便、中西药并重、基本保障、临床首选和基层能够配备（E对）。国家基本药物目录的制定：国家卫生健康委员会会同有关部门起草国家基本药物目录遴选工作方案和具体的遴选原则，经国家基本药物工作委员会审核后组织实施。国家基本药物遴选应当按照防治必需、安全有效、价格合理、使用方便、中西药并重、基本保障、临床首选和基层能够配备的原则，结合我国用药特点，参照国际经验，合理确定品种（剂型）和数量。国家基本药物应当是《中华人民共和国药典》收载的，国家卫生健康部门、国家药品监督管理部门颁布药品标准的品种。除急救、抢救用药外，独家生产品种纳入国家基本药物目录应当经过单独论证。下列药品不纳入国家基本药物目录遴选范围：①含有国家濒危野生动植物药材的；②主要用于滋补保健作用，易滥用的；③非临床治疗首选的；④因严重不良反应，国家药品监督管理部门明确规定暂停生产、销售或使用的；⑤违背国家法律、法规，或不符合伦理要求的；⑥国家基本药物工作委员会规定的其他情况。合理用药是指安全、有效、经济（A错）地使用药物。医疗机构应当遵循有关药物临床应用指导原则、临床路径、临床诊疗指南和药品说明书等合理使用药物；对医师处方、用药医嘱的适宜性进行审核。基于药品质量特性和特殊性，药品管理需要对药品安全性、有效性和质量可控制（B错）进行全程管理。国家对药品实施注册管理，核心目标就是为了保证药品安全性、有效性和质量可控制。医保药品目录的确定条件：根据《城镇职工基本医疗保险用药范围管理暂行办法》第三条，纳入医保药品目录的药品，应是临床必需、安全有效、价格合理、使用方便、市场能够保证供应（C错）的药品，并具备下列条件之一：《中华人民共和国药典》（现行版）收载的药品；符合国家药品监督管理部门颁发标准的药品；国家药品监督管理部门批准正式进口的药品。